碘酚治疗适用于
A. 龈袋
B. 骨上袋
C. 骨下袋
D. 牙龈红肿者
E. 牙周袋溢脓者

正确答案：E。牙周袋溢脓者

解析：本题考查牙周病的局部药物治疗。碘酚含碘和酚，为腐蚀性较强的药物，有腐蚀坏死组织、消除溢脓、减少炎性渗出等作用，碘酚适用于牙周袋溢脓者（E对）。龈袋（A错）为假性牙周袋，一般无溢脓，洁治后龈袋深度超过3mm者，可手术切除。骨上袋（B错）在基础治疗的基础上翻瓣去除牙石、菌斑等。骨下袋（C错）可用牙周组织再生术（GTR）等进行治疗。牙龈红肿者（D错）采用洁治术一般可消除红肿炎症。